因易导致新生儿溶血，妊娠晚期妇女禁用的抗菌药物是
A. 庆大霉素
B. 呋喃妥因
C. 苄星青霉素
D. 甲硝唑
E. 左氧氟沙星

正确答案：B。呋喃妥因

解析：本题考查呋喃妥因。因易导致新生儿溶血，妊娠晚期妇女禁用的抗菌药物是呋喃妥因（B对）。庆大霉素（A错）不良反应为耳毒性。苄星青霉素（C错）不良反应为过敏反应。甲硝唑（D错）常见消化道不良反应。左氧氟沙星（E错）不良反应为消化道反应和过敏反应。